过期妊娠时
A. 孕妇体重不再增加或稍减轻
B. 孕妇体重稍增加
C. 孕妇体重继续增加
D. 羊水量保持不变
E. 羊水继续增加

正确答案：A。孕妇体重不再增加或稍减轻